慢性甲基汞中毒最早出现的临床症状常是
A. 中心性视野缩小
B. 运动失调
C. 精神症状
D. 谵妄
E. 语言和听力障碍

正确答案：C。精神症状

解析：本题考查慢性甲基汞中毒最早出现的临床症状。慢性甲基汞中毒是人群长期暴露于被汞（甲基汞）污染的环境，主要是水体汞（甲基汞）污染和由此导致的鱼贝类等食物甲基汞污染，造成摄入者体内甲基汞蓄积并超过一定阈值所引起的以中枢神经系统损伤为主要中毒表现的环境污染性疾病。其最早出现的症状是神经精神症状（C对），早期表现为神经衰弱综合征，少数严重者，症状可持续发展加重，表现为精神障碍。严重者可出现神志障碍、谵妄（D错）、昏迷、锥体外系受损等。重症患者可出现肢端感觉麻木、向心性视野缩小（A错）、共济运动失调（B错）、语言和听力障碍（E错）等典型症状。